轻度营养不良皮下脂肪减少的部位主要是
A. 面部
B. 四肢
C. 腹部
D. 背部
E. 全身

正确答案：C。腹部